女性，24岁。突发寒战高热，咳嗽咳痰，右胸痛3天，予退热药后出现大汗淋漓，头晕眼花，心悸，速来急诊。查体：神志清楚，血压70/45mmHg，心率130次/分钟，呼吸急促，口唇发绀，右下肺叩诊呈浊音，可闻及管状呼吸音；血白细胞25.6×10⁹/L，中性粒细胞O.86；X线显示：右下肺大片炎症浸润阴影。其诊断是
A. 肺炎球菌肺炎
B. 肺脓肿
C. 休克型肺炎
D. 支原体肺炎
E. 葡萄球菌肺炎

正确答案：C。休克型肺炎

解析：青年女性，突发寒战高热，咳嗽咳痰，右胸痛3天（为肺炎的典型临床表现），予退热剂后出现大汗淋漓，头晕，眼花，心悸（为休克表现），查体：神志清楚，血压70/45mmHg，心率130次/分（血压降低，心率加快，显示患者为休克状态），呼吸急促，口唇发绀（提示缺氧），右下肺叩浊音，可闻及管状呼吸音（肺炎体征），辅助检查示：血白细胞25.6×10⁹/L，中性粒细胞0.86，X线示：右下肺大片炎症浸润阴影（血象为白细胞和中性粒细胞升高为主，结合X线表现，提示细菌性肺炎），结合患者的临床表现，体征及辅助检查，可确定患者为细菌性肺炎导致的感染性休克状态（C对），不单纯是细菌性肺炎（AE错）。肺脓肿的早期表现于肺炎球菌肺炎相似，但随病程进展，咳出大量脓臭痰，其X线显示脓腔及气液平（B错）。支原体肺炎其骑兵较缓慢，症状主要为乏力、咽痛、头痛、咳嗽、发热等，查体可见咽部充血，X线见肺部多种形态的浸润影，呈节段性分布，多见于肺下野，近肺门较深，逐渐向外带伸展（D错）。